反映左、右心房电激动过程的是
A. P波
B. P-R段
C. QRS波群
D. ST段
E. T波

正确答案：A。P波

解析：反应左、右心房点激动的过程的是P波（A对）。P-R段（B错）反应心房复极过程及房室结、希氏束、束支的点活动。QRS波群（C错）反应心室除极的全过程。ST段（D错）反应心室缓慢复极过程。T波（E错）反应心室快速复极过程。